国外胰腺炎最常见病因
A. 胆道疾病
B. 过量饮酒
C. 暴饮暴食
D. 高脂血症
E. 十二指肠液反流

正确答案：B。过量饮酒

解析：过量饮酒为国外胰腺炎最常见的病因（B对）。胆道疾病是我国胰腺炎最常见的病因（A错）。暴饮暴食，进食荤食是胰腺炎发病的诱因（C错）。高脂血症和十二指肠液返流与急性胰腺炎的发病有关，但并不是我国胰腺炎发病的主要原因（DE错）。